在一项疫苗试验中，对随机选择的1000名2岁儿童注射疫苗并追踪观察10年，其中80%从未患病。对于该疫苗的效果，下列哪项结论是正确的
A. 疫苗非常好，因为有高的免疫率
B. 由于没有对不接种儿童进行追踪观察，所以得不出什么结论
C. 疫苗并非特别有效，因为免疫率低
D. 未作统计学检验而得不出结论
E. 患病率为100%－80%＝20%

正确答案：B。由于没有对不接种儿童进行追踪观察，所以得不出什么结论

解析：本题考查队列研究的实际应用。队列研究通过直接观察某因素不同暴露状况人群的结局来探讨该因素与所观察结局的关系，对照组时队列研究的重要因素。本题试验对注射疫苗的暴露组进行随访，而没有对不接种儿童进行追踪观察，因此试验不够严谨，无法得出有意义的结论（B对ACDE错）。